关于风湿性疾病的概念，说法正确的是
A. 风湿性疾病就是自身免疫性疾病
B. 风湿性疾病就是指风湿性关节和类风湿性关节性疾病
C. 结缔组织病是风湿性疾病的一部分
D. 风湿性疾病是结缔组织病的一部分
E. 风湿性疾病就是结缔组织病

正确答案：C。结缔组织病是风湿性疾病的一部分

解析：风湿性疾病泛指影响骨、关节及其周围软组织，如肌肉、滑囊、肌腱、筋膜、神经等的一组疾病（B错）。而结缔组织病仅仅指风湿性疾病中结缔组织受累的疾病，包括红斑狼疮、类风湿关节炎等。因此，结缔组织病是风湿性疾病的一部分，但风湿病不只限于结缔组织病，（C对DE错）。风湿性疾病的病因可以是感染性、免疫性、代谢性、内分泌性、退行性、地理环境性、遗传性、肿瘤性等（A错）。